女，45岁。甲状腺癌根治术后1天。感觉面部针刺样麻木，间断手足抽搐。正确的处理措施是
A. 口服葡萄糖酸钙
B. 静脉注射钙剂
C. 气管切开
D. 口服维生素D₃
E. 伤口切开

正确答案：B。静脉注射钙剂

解析：患者中年女性，甲状腺癌根治术后（甲状腺癌根治术后病史，甲状旁腺功能减退是手术后主要并发症），感觉面部针刺样麻木，间断手足抽搐（低钙血症症状）。根据患者病史及临床表现，可以诊断为甲状旁腺功能减退。甲状腺癌根治术后的甲状旁腺功能减退是因手术时误伤及甲状旁腺和其血液供给受累所致。血钙浓度下降，神经肌肉的应激性显著增高，多在术后一到三天出现症状。起初，多数病人只有面部，唇部和手足部的针刺样麻木感或强直感，严重者可出现面肌和手足伴有疼痛的持续性痉挛，每天发作数次，更严重者可出现面喉和膈肌痉挛，引起窒息死亡。抽搐发作时立即静脉注射钙剂（B对）（P230）。症状轻者可口服葡萄糖酸钙（A错），但不如静脉注射钙剂起效快。气管切开（C错）主要用于甲状腺术后并发症术后呼吸困难和窒息的治疗（P229）。口服维生素D₃（D错）主要用于症状较重或长期不能恢复者，用于加服，以促进钙在肠道内的吸收。伤口切开（E错）主要针对于伤口内出血，血肿压迫气管，对于低钙血症无治疗作用。